结肠破裂
A. 腹膜炎出现早
B. 腹膜炎严重，呈板状腹
C. 腹膜炎出现较晚，但较重
D. 腹膜炎出现较晚且较轻
E. 无腹膜刺激征

正确答案：C。腹膜炎出现较晚，但较重

解析：由于结肠内容物液体成分少而细菌含量多，因此结肠破裂后，腹膜炎出现得较晚，但较重（C对）。腹膜炎出现早（A错）为小肠损伤（P326）的特点。腹膜炎严重，呈板状腹（B错）为胃穿孔的特点。腹膜炎出现较晚且较轻（D错）为胰腺损伤（P325）的特点。腹膜刺激征可见于大多数腹部闭合性损伤的患者（E错）。